张某，药学本科毕业之后，在医院药剂科工作2年，然后在药品零售企业工作2年。关于其申请执业药师资格考试或者执业的说法，正确的有
A. 张某已具备参加当年度执业药师资格考试的条件
B. 若张某取得《执业药师资格证书》，即可以执业药师身份执业
C. 若张某取得《执业药师资格证书》，只能在其户籍所在地注册
D. 张某成为执业药师后，应当按照规定参加执业药师继续教育
E. 张某成为执业药师后，应在注册有效期满前3个月办理再注册手续

正确答案：A、D。张某已具备参加当年度执业药师资格考试的条件；张某成为执业药师后，应当按照规定参加执业药师继续教育

解析：本题考查的是执业药师职业资格考试与注册管理。张某，药学本科毕业之后，在医院药剂科工作2年，然后在药品零售企业工作2年。关于其申请执业药师资格考试或者执业的说法，正确的有张某已具备参加当年度执业药师资格考试的条件（A对）；张某成为执业药师后，应当按照规定参加执业药师继续教育（D对）。执业药师职业资格考试的报名条件：凡中华人民共和国公民和获准在我国境内就业的外籍人员，具备以下条件之一者，均可申请参加执业药师职业资格考试：①取得药学类、中药学类专业大专学历，在药学或中药学岗位工作满5年；②取得药学类、中药学类专业大学本科学历或学士学位，在药学或中药学岗位工作满3年；③取得药学类、中药学类专业第二学士学位、研究生班毕业或硕士学位，在药学或中药学岗位工作满1年；④取得药学类、中药学类专业博士学位；⑤取得药学类、中药学类相关专业相应学历或学位的人员，在药学或中药学岗位工作的年限相应增加1年。凡符合执业药师职业资格考试相应规定的香港、澳门、台湾居民，按照规定的程序和报名条件，可报名参加考试。执业药师继续教育：根据《专业技术人员继续教育规定》和12号文，执业药师（包括取得《执业药师职业资格证书》的人员）应当按照国家专业技术人员继续教育的有关规定接受继续教育，更新专业知识，提高业务水平。接受继续教育是执业药师的义务和权利，执业药师必须按规定积极参加继续教育，完善知识结构、增强创新能力、提高专业水平。用人单位应当保障执业药师参加继续教育的权利。执业药师的继续教育学分，应由继续教育管理机构及时记入全国执业药师注册管理信息系统。执业药师注册要求：我国执业药师实行注册制度，国家药品监督管理局负责执业药师注册的政策制定和组织实施，指导全国执业药师注册管理工作。各省、自治区、直辖市药品监督管理部门负责本行政区域内的执业药师注册管理工作（C错）。取得执业药师职业资格的药学专业技术人员，经执业单位考核同意，通过全国执业药师注册管理信息系统向所在地注册管理机构申请注册。经批准注册者，由执业药师注册管理机构核发国家药监局统一样式的《执业药师注册证》，方可从事相应的执业活动。未经注册者，不得以执业药师身份执业（B错）。执业药师注册有效期为五年。需要延续的，应当在有效期届满三十日前，向所在地注册管理机构提出延续注册申请（E错）。